女，35岁。进行性四肢乏力1年，早晨较轻，下午加重。既往有胸腺瘤病史、否认甲状腺功能亢进症病史。运动疲劳试验阳性。目前临床考虑为重症肌无力，给予胆碱酯酶抑制剂后症状缓解，但随之最可能出现的新症状是
A. 腹泻
B. 心动过速
C. 瞳孔扩大
D. 口干
E. 呼吸困难

正确答案：A。腹泻

解析：重症肌无力患者，给予胆碱酯酶抑制剂后症状缓解，但随之最可能出现的新症状是毒蕈碱样反应：瞳孔缩小（C错）、心动过缓（B错）、流涎（D错）、多汗、腹痛、腹泻（A对）和呕吐等。